心理实质的内容不包括
A. 心理发展的生物学基础
B. 心理的实质
C. 心理与脑科学的研究
D. 生理发展是心理发展的物质基础
E. 遗传为心理的发展提供必然性

正确答案：E。遗传为心理的发展提供必然性